从伤害的能量交换模型出发，伤害发生的原因包括
A. 宿主、环境和遗传
B. 机体、生物环境和社会环境
C. 致病因子、宿主和环境
D. 遗传、环境和社会
E. 患者、家属和社会

正确答案：C。致病因子、宿主和环境